下列哪项不是活动期牙周炎的病理变化
A. 牙周袋内有大量炎性渗出物
B. 沟内上皮出现糜烂
C. 结合上皮向根方增殖
D. 牙槽骨出现活跃破骨细胞
E. 牙周膜间隙变窄

正确答案：E。牙周膜间隙变窄

解析：本题考查活动期牙周炎的病理变化。牙周膜间隙变窄（E错，为本题正确答案）不是活动期牙周炎的病理变化。活动期牙周炎时牙周膜的基质及胶原变性、降解，由于骨的吸收、破坏，导致牙周膜间隙增宽。活动期牙周炎的病理变化有：1.牙面上可见不同程度的菌斑、软垢及牙石堆积；2.牙周袋内有大量炎性渗出物（A对）、免疫球蛋白、补体等成分；3.沟内上皮出现糜烂（B对）或溃疡；4.结合上皮向根方增殖延伸（C对）；5.沟内上皮及结合上皮下方的胶原纤维水肿变性丧失；6.牙槽骨出现活跃的破骨细胞性骨吸收陷窝（D对）；7.牙周膜间隙增宽；8.牙石同牙骨质牢固地附着根面。